男性，71岁，吸烟患者，反复咳嗽，咳痰气促40年，胸闷，心悸2年，加重伴发热1周，昏睡3小时入院。查体：BP140/90mmHg，嗜睡状态，呼之能应，瞳孔等大等圆，对光反射存在，口唇紫绀，双肺可闻及干湿啰音，心率120次/分，期前收缩3次/分，下肢凹陷性水肿。假设上述诊断成立，补充体检时还可能出现的最主要的体征是
A. 心音强弱快慢不等
B. 心界向左下扩大
C. 心界向左右两侧扩大
D. 肺动脉瓣区第二心音亢进
E. 心尖区可闻及3/6级粗糙吹风样全收缩期杂音

正确答案：D。肺动脉瓣区第二心音亢进

解析：患者为老年男性，有吸烟史（为慢阻肺最重要的环境发病因素），反复咳嗽、咳痰、气促（为慢阻肺的典型表现），提示为慢阻肺（COPD）。现加重伴发热，昏睡，下肢凹陷性水肿，根据其临床表现和体征，考虑诊断为由COPD引起的肺源性心脏病。肺动脉高压的形成是肺源性心脏病发病的先决条件，因此肺动脉高压的特征性临床表现肺动脉瓣区第二心音亢进可为体检时最主要的体征（D对）。心音强弱快慢不等（P188）（A错）为房颤的表现。心界向左下扩大（B错）为左心室肥大的表现。心界向左右两侧扩大（C错）为心包积液的表现。心尖区可闻及3/6级粗糙吹风样全收缩期杂音（E错）为二尖瓣关闭不全的表现，肺心病右心室肥大表现为三尖瓣区收缩期杂音。